以荚膜为其主要致病物质的是
A. 金黄色葡萄球菌
B. A群链球菌
C. 肺炎链球菌
D. 变异链球菌
E. 淋病奈瑟菌（淋球菌）

正确答案：C。肺炎链球菌